可引起血脂紊乱的降压药是
A. 呋塞米
B. 氢氯噻嗪
C. 甘露醇
D. 螺内酯
E. 氨苯蝶啶

正确答案：B。氢氯噻嗪

解析：本题考查氢氯噻嗪的不良反应。可引起血脂紊乱的降压药是氢氯噻嗪（B对）。噻嗪类利尿药可升高LDL、总胆固醇和三酰甘油水平。呋塞米（A错）为袢利尿剂，常见不良反应有水、电解质紊乱、低钾血症、耳毒性、高尿酸血症等。甘露醇（C错）为渗透性利尿剂，不良反应以水和电解质紊乱最为常见，还可引起寒战、发热，排尿困难，血栓性静脉炎。螺内酯（D错）和氨苯蝶啶（E错）为保钾利尿药，常见不良反应有高钾血症，少见低钠血症，长期服用可致男性乳房发育、阳痿、性功能减退，可致女性乳房胀痛、声音变粗、毛发增多、月经失调、性功能下降。